月经过多所致贫血宜选用
A. 华法林
B. 尿激酶
C. 维生素K
D. 维生素B₁₂
E. 硫酸亚铁

正确答案：E。硫酸亚铁